患者，男，7岁。右下后牙菜花样溃疡2个月，溃疡约2.8cm×3cm大小，临近溃疡的牙齿略松动，右颈上部触及一淋巴结，约1.5cm×2.0cm大小，质偏硬、尚可活动，未发现远处转移。上述疾病TNM分类应是
A. T1N1M0
B. T2N1M0
C. T1N2M0
D. T4N2M0
E. T4N3M0

正确答案：B。T2N1M0

解析：肿瘤的分期：T表示原位癌的分期，以肿瘤最大直径的大小来评判，患者肿瘤2.8cm×3cm大小，属于T2期；N表示淋巴结转移分期，本患者同侧单个淋巴结转移，大小为1.5cm×2.0cm，属于N1期；M表示有无远处转移，此患者明显无远处转移。掌握“鳞状细胞癌概述及舌癌、牙龈癌”知识点。